治疗夏伤暑湿，身热烦渴，小便不利，泄泻者，应首选
A. 茯苓
B. 猪苓
C. 金钱草
D. 滑石
E. 泽泻

正确答案：D。滑石

解析：夏伤暑湿，身热烦渴，治当清热解暑，小便不利，泄泻者治当利尿通淋,所谓“利小便以实大便”。滑石具有利尿通淋，清热解暑，收湿敛疮的功效（D对）。茯苓具有利水渗湿，健脾，宁心的功效，没有清热解暑的功效（A错）。猪苓具有利水渗湿的功效，没有清热解暑的功效（B错）。金钱草具有利湿退黄，利尿通淋，解毒消肿的功效，没有清热解暑的功效（C错）。泽泻具有利水渗湿，泻热的功效，没有清热解暑的功效（E错）。